下列关于统计表制作的叙述，正确的是
A. 纵标目间用竖线分隔
B. 横、纵标目用斜线分隔
C. 要求各种指标小数位数一致
D. 一张表应包含尽量多的内容
E. 统计表通常包括标题、标目、线条、数字4部分

正确答案：E。统计表通常包括标题、标目、线条、数字4部分